以下哪项不是肺血栓栓塞症体征
A. 发绀
B. 肺部湿啰音
C. 心动过速
D. 颈静脉充盈或异常搏动
E. 频发期前收缩

正确答案：E。频发期前收缩

解析：肺血栓栓塞症是来自静脉系统或右心的血栓阻塞肺动脉或其分支所导致的以肺循环和呼吸功能障碍为主要临床和病理生理特征的疾病，其体征主要有：1.呼吸系统体征以呼吸急促最常见，另有发绀（A对），肺部哮鸣音和（或）细湿啰音（B对）等。2.循环系统体征包括心动过速（C对），血压变化，严重时可出现血压下降甚至休克，颈静脉充盈或搏动（D对），肺动脉瓣区第二心音亢进或分裂，三尖瓣区收缩期杂音。3.还可伴有发热等体征。而期前收缩（E错，为本题正确答案）又称早搏，常见于冠心病、风湿性心脏病、高血压性心脏病、心肌病等，亦可偶发于正常人。